《中华人民共和国药品管理法》规定，没收违法生产、销售的药品和违法所得，并处违法生产、销售药品货值金额二倍以上五倍以下罚款的是
A. 采取欺骗手段取得药品批准证明文件的
B. 生产、销售假药的
C. 生产、销售劣药的
D. 药品生产、经营企业未按GMP、GSP规定实施的
E. 进口药品未按规定向药品监督管理部门登记备案的

正确答案：B。生产、销售假药的

解析：本题考查假药。根据《药品管理法》第一百一十六条规定，生产、销售假药（B对）的，没收违法生产、销售的药品和违法所得，责令停产停业整顿，吊销药品批准证明文件，并处违法生产、销售的药品货值金额十五倍以上三十倍以下的罚款；货值金额不足十万元的，按十万元计算；情节严重的，吊销药品生产许可证、药品经营许可证或者医疗机构制剂许可证。